病毒在下列哪种情况下可脱离免疫逃逸状态
A. 病毒基因高频突变
B. 病毒急性感染期
C. 免疫抑制
D. 分子模拟
E. 干扰抗原提呈

正确答案：E。干扰抗原提呈